以下关于增加冠桩固位的方法，不正确的是
A. 根管口预备一小肩台
B. 增加桩与管壁的密合度
C. 选用优良粘接剂
D. 尽可能保留残冠硬组织
E. 尽可能去除残冠硬组织

正确答案：E。尽可能去除残冠硬组织

解析：本题考查增加冠桩固位的方法。关于增加冠桩固位的方法不正确的是尽可能去除残冠硬组织（E错，为本题的正确答案）。剩余牙体组织的量和牙本质肩领的形成对于冠桩的远期效果意义重大，尽可能保留残冠硬组织（D对）并在根管口预备一小肩台（A对），即形成牙本质肩领，可以增加接触面积，增强固位，也可以提高牙齿的完整性，增加患牙的抗折强度，防止冠根折断。增加桩与管壁的密合度（B对），以减少受力时的不稳定，利于固位。粘接力是桩核固位力的重要来源之一，选用优良粘接剂（C对）以提高粘接力，可增加固位。